龟甲的功效是
A. 滋阴潜阳
B. 益肾健骨
C. 养血生津
D. 活血化瘀
E. 软坚散结

正确答案：A、B。滋阴潜阳；益肾健骨

解析：本题考查的是龟甲的功效。龟甲的功效是滋阴潜阳（A对）与益肾健骨（B对）。龟甲：【功效】滋阴潜阳，益肾健骨，养血补心，凉血止血。党参：【功效】补中益气，生津养血（C错）。五灵脂：【功效】活血止痛，化瘀（D错）止血，解蛇虫毒。鳖甲：【功效】滋阴潜阳，退热除蒸，软坚散结（E错）。